具有补气养血、调经止带功能的中成药是
A. 花红颗粒
B. 固经丸
C. 安坤颗粒
D. 乌鸡白凤丸
E. 妇科十味片

正确答案：D。乌鸡白凤丸

解析：本题考查乌鸡白凤丸的功能。具有补气养血、调经止带功能的中成药是乌鸡白凤丸（D对）。乌鸡白凤丸（片）【功能】补气养血，调经止带。花红颗粒（A错）【功能】清热解毒，燥湿止带，祛瘀止痛。固经丸（B错）【功能】滋阴清热，固经止带。安坤颗粒（C错）【功能】滋阴清热，养血调经。妇科十味片（E错）【功能】养血舒肝，调经止痛。